发现肺结核的重要措施是
A. 锻炼身体，增强体质
B. 预防性服用异烟肼
C. 定期做结核菌素试验
D. 胸部X线检查
E. 接种卡介苗

正确答案：D。胸部X线检查

解析：肺结核的一般诊断：须结合流行病学资料、临床表现与实验室、影像学辅助检查综合分析，主要的诊断依据为胸部X线（D对）、CT检查以及痰菌检查。细菌学检查是肺结核诊断的确切依据，但不是所有的肺结核都可得到细菌学证据。胸部X线检查是重要的辅助检查。一般而言，肺结核胸部X线表现可有如下特点：①多发生在肺上叶尖后段、肺下叶背段、后基底段。②病变可局限也可侵犯多肺段。：③X线影像可呈多形态表现（即同时呈现渗出、增殖、纤维和干酪性病变），也可伴有钙化。④易合并空洞。⑤可伴有支气管播散灶。⑥可伴胸腔积液、胸膜增厚与粘连。⑦呈球形病灶时（结核球）直径多在3cm以内，周围可有卫星病灶，内侧端可有引流支气管征。⑧病变吸收慢（1个月以内变化较小）。锻炼身体，增强体质（A错）有助于提高抵抗力，防止肺结核传播。预防性服用异烟肼（B错）有利于迅速发挥早期杀菌作用，防止肺结核传播，为预防性治疗措施。定期做结核菌素试验（C错）为评估抗痨治疗效果的手段之一。接种卡介苗（E错）为结核病的预防性治疗措施。